诊断妊娠期高血压时，主要应与下述的哪种疾病相鉴别
A. 高血压
B. 慢性肾炎合并妊娠
C. 慢性肾炎合并高血压
D. 糖尿病合并高血压
E. 高血脂合并妊娠

正确答案：B。慢性肾炎合并妊娠